患者年龄是21岁，PD4-6，经常出血，牙龈肿胀，龈缘有红边，经过牙周治疗一年来未见好转，可能的致病菌
A. 伴放线聚集杆菌
B. 牙龈卟啉单胞菌
C. 白色念珠菌
D. 中间普氏菌

正确答案：C。白色念珠菌

解析：本题考查为与HIV有关的牙周病损。据题干的临床表现可诊断为线形牙龈红斑(LGE)，在龈缘处有明显的鲜红的宽约2-3mm的红边，在附着龈上可呈淤斑状，极易出血。近年来已知LGE与口腔白色念珠菌（C对）感染有关。